一般应加适当抑菌剂的眼用制剂是
A. 眼内插入剂
B. 多剂量眼用制剂
C. 眼内注射溶液
D. 急救用的眼用制剂
E. 供外科手术用的眼用制剂

正确答案：B。多剂量眼用制剂

解析：本题考查的是眼用制剂的添加剂。一般应加适当抑菌剂的眼用制剂是多剂量眼用制剂（B对）。多剂量眼用制剂一般应加适当抑菌剂，尽量选用安全风险小的抑菌剂，产品标签应标明抑菌剂种类和标示量。除另有规定外，在制剂确定处方时，该处方的抑菌效力应符合《中国药典》抑菌效力检查法的规定。眼内注射溶液（C错）、眼内插入剂（A错）、供外科手术用（E错）和急救用的眼用制剂（D错），均不得添加抑菌剂、抗氧剂或不适当的附加剂，且应采用一次性使用包装。